母婴保健工作人员出具虚假医学证明，即使未造成严重后果，仍应承担一定的法律责任。该法律责任是
A. 暂停执业
B. 行政处分
C. 吊销执业证书
D. 通报批评
E. 注销执业注册

正确答案：B。行政处分

解析：从事母婴保健技术服务的人员出具虚假医学证明文件而未造成严重后果的，依法给予行政处分（B对）；有下列情形之一的，由原发证部门撤销相应的母婴保健技术执业资格或者医师执业证书（C错）：①因延误诊治，造成严重后果的；②给当事人身心健康造成严重后果的；③造成其他严重后果的。暂停执业（A错）、通报批评（D错）、注销执业注册（E错）不属于母婴保健工作人员出具虚假医学证明文件的法律责任